发热对体温每升高1℃，心率平均约增加
A. 5次
B. 18次
C. 15次
D. 20次
E. 25次

正确答案：B。18次

解析：发热时心率加快，体温每上升1°C，心率约增加18次/分（B对）。